铅丹的功效为
A. 收敛生肌
B. 明目去翳
C. 二者均是
D. 二者均不是

正确答案：A。收敛生肌

解析：本题考查的是铅丹的功效。铅丹的功效为收敛生肌（A对）。铅丹：【功效】外用拔毒止痒，敛疮生肌；内服坠痰镇惊，攻毒截疟。炉甘石：【功效】明目去翳（B错），收湿生肌。